男，45岁，自述后牙咬合无力，偶有疼痛。X线片示左下颌第二磨牙根尖有边界清楚的透射区。镜下可见边界清楚的炎性团块，内有新生的毛细血管、成纤维细胞及各种炎细胞。这是
A. 慢性根尖周囊肿
B. 慢性根尖周脓肿
C. 慢性根尖周肉芽肿
D. 慢性牙髓炎
E. 以上都不是

正确答案：C。慢性根尖周肉芽肿

解析：本题考查慢性根尖周肉芽肿。慢性根尖周肉芽肿X线片示边界清楚的透射区，镜下可见边界清楚的炎性团块，内有新生的毛细血管、成纤维细胞及各种炎细胞（C对）。慢性根尖周囊肿X线可见圆形透射区，边界清楚，并有一圈由致密骨组成的阻射白线围绕（A错）。慢性根尖周脓肿X线示根尖周呈现边界模糊的不规则透射影像。脓肿中央为坏死液化组织和脓细胞，脓肿周围为炎性肉芽组织（B错）。慢性牙髓炎X线片无明显异常，慢性牙髓炎的诊断主要结合临床症状（D错）。